伴有糖尿病的水肿病人，不宜选用
A. 氢氯嚦嗪
B. 吲达帕胺
C. 氨苯蝶啶
D. 螺内酯
E. 乙酰唑胺

正确答案：A。氢氯嚦嗪